与电源直接接触所致电烧伤的主要特点
A. 损伤范围通常外小内大
B. 电流“出口”处较“入口”处损伤重
C. 伤后坏死范围一般不会再扩大
D. 局部渗出较一般烧伤轻
E. 有明显的坏死层面

正确答案：A。损伤范围通常外小内大

解析：电接触烧伤的局部特点包括：①电流通过人体有“入口”和“出口”，入口处较出口处损伤重（B错）；②入口处常有炭化，形成裂口或洞穴，烧伤常深达肌肉、肌腱、骨周，损伤范围常外小内大（A对）；③没有明显的坏死层面（E错）；④局部渗出较一般烧伤重（D错），包括筋膜腔内水肿；⑤由于邻近血管的损害，经常出现进行性坏死，伤后坏死范围可扩大数倍（C错）。